影响混悬型药物物理稳定性的因素有
A. 微粒的沉降
B. 微粒的荷电和水合
C. 微粒的结晶转型
D. 微粒的絮凝和反絮凝
E. 微粒的结晶增长

正确答案：A、B、C、D、E。微粒的沉降；微粒的荷电和水合；微粒的结晶转型；微粒的絮凝和反絮凝；微粒的结晶增长

解析：本题考查影响混悬型药物物理稳定性的因素。影响混悬型药物物理稳定性的因素包括微粒的沉降（A对）、微粒的荷电和水合（B对）、微粒的结晶转型（C对）、微粒的絮凝和反絮凝（D对）及微粒的结晶增长（E对）。